在食品中残留期最长的农药是
A. 有机氯
B. 有机磷
C. 氨基甲酸酯类
D. 拟除虫菊酯类
E. 杀菌剂

正确答案：A。有机氯